药物稳定性长期实验的条件是
A. 供试品开口置适宜的洁净容器中，60℃温度下放置10天
B. 供试品开口置恒湿密闭容器中，在温度25℃、相对湿度（90±5）%条件下放置10天
C. 供试品开口放置在光橱或其它适宜的光照容器内，在照度为（4500±500）lx条件下放置10天
D. 供试品按市售包装，在温度（40±2）℃、相对湿度（75±5）%条件下放置6个月
E. 供试品按市售包装，在温度（25±2）℃、相对湿度（60±10）%条件下放置12个月，并继续放置至36个月

正确答案：E。供试品按市售包装，在温度（25±2）℃、相对湿度（60±10）%条件下放置12个月，并继续放置至36个月

解析：本题考查药物稳定性试验方法。药物稳定性长期实验的条件是供试品按市售包装，在温度（25±2）℃、相对湿度（60±10）%条件下放置12个月，并继续放置至36个月（E对）。药物稳定性的长期实验又称为留样观察实验，是在接近药品贮存的实际条件下进行的，目的是为制定药物有效期提供依据。基本要求为：供试品按市售包装在温度（25±2）℃、相对湿度（60±10）%条件下放置12个月，于0、3、6、9、12个月取样，并继续放置至36个月，于18、24、36个月进行取样检查。药物稳定性影响因素实验包括：①高温实验，将供试品开口置适宜的洁净容器中，60℃温度下放置10天，于第5、10天取样检查（A错）。②高湿度实验，将供试品开口置恒湿密闭容器中，在温度25℃、相对湿度（90±5）%条件下放置10天，于第5、10天取样检查（B错）。③强光照实验，将供试品开口放置在光橱或其它适宜的光照容器内，在照度为（4500±500）lx条件下放置10天，于第5、10天取样检查（C错）。药物稳定性加速试验条件为供试品按市售包装，在温度（40±2）℃、相对湿度（75±5）%条件下放置6个月，于0、1、2、3、6个月取样测定（D错）。